单纯窒息性气体
A. 一氧化碳
B. 二甲苯
C. 氰化物
D. 二氧化硫
E. 二氧化碳

正确答案：E。二氧化碳

解析：本题考查单纯窒息性气体的概念。单纯窒息性气体是指一类本身无毒，或毒性很低，或为惰性气体，但由于它们的存在使空气中氧的比例和含量明显降低，相应地进入呼吸道、血液和组织细胞的氧含量也降低，导致机体缺氧、窒息的气体。如氮、氢、甲烷、乙烷、丙烷、丁烷、乙烯、乙炔、二氧化碳（E对ABCD错）、水蒸气以及氦、氖、氩等惰性气体。